女性，35岁。因甲状腺肿块在当地行甲状腺肿块切除术后5天，病理学诊断为甲状腺乳头状癌Ⅱ级，对该患者的进一步处理
A. 终身服用甲状腺素片
B. 行放射性外照射
C. 行放射性碘治疗
D. 再次手术，行患侧全切及对侧全切
E. 再次手术，行患侧全切，峡部切除及对侧大部切除

正确答案：E。再次手术，行患侧全切，峡部切除及对侧大部切除

解析：患者5天前因良性病变行甲状腺肿块切除术，术后病理诊断为甲状腺乳头状癌Ⅱ级，癌细胞分化程度不高，须行甲状腺全切或近全切。因此，该患者的首选治疗为再次手术，行患侧全切，峡部切除及对侧大部切除（E对D错）。终身服用甲状腺素片（A错）多作为术后辅助治疗，可预防甲状腺功能减退并抑制TSH分泌，减少肿瘤复发。行放射性碘治疗（C错）用于分化型甲状腺癌的术后辅助治疗。行放射性外照射（B错）主要用于治疗未分化型甲状腺癌。